各种周围血管疾病的描述中，不正确的是
A. 雷诺病女性多见
B. 血栓闭塞性脉管炎男性多见
C. 血栓闭塞性脉管炎的特点是对称性和间歇性
D. “疼痛性股白肿”最常发生在产后
E. 血栓闭塞性脉管炎多发生在下肢

正确答案：C。血栓闭塞性脉管炎的特点是对称性和间歇性

解析：雷诺病女性多见（A对），好发于手指，常为双侧性，表现为受累部位依次出现苍白、青紫和潮红。血栓闭塞性脉管炎以男性多见（B对），多侵袭四肢中、小动静脉，以下肢多见（E对），早期呈间歇性发作，但无对称性（C错，为本题正确答案）。“疼痛性股白肿”为全下肢深静脉血栓形成的临床表现，最常发生在产后（D对）。